关于急性中毒的治疗原则，不正确的是
A. 酸性毒物污染皮肤、黏膜后应用碱性液体冲洗、中和
B. 立即终止接触毒物
C. 迅速清除进入体内已经被吸收或尚未被吸收的毒物
D. 及早使用特效解毒剂和拮抗剂
E. 根据患者不同情况进行对症治疗

正确答案：A。酸性毒物污染皮肤、黏膜后应用碱性液体冲洗、中和

解析：多数酸性毒物污染皮肤粘膜后可应用碱性液体冲洗中和（A错，为本题正确答案），但部分酸性毒物如浓硫酸不宜用碱液冲洗。浓硫酸遇水稀释及酸碱中和反应可释放大量的热量，造成局部严重烧伤，正确的处理方法是干布擦拭后以大量清水冲洗。终止接触毒物（B对）、迅速清除进入体内已经被吸收或尚未被吸收的毒物（C对）、及早使用特效药解毒剂和拮抗剂（D对）可减少毒物对机体的损伤。急性中毒时患者临床表现复杂，治疗方案应个体化，即根据患者不同情况进行对症治疗（E对）。